膀胱Ta期乳头状癌的治疗方法首选
A. 膀胱全切除术
B. 膀胱部分切除术
C. 局部放疗
D. 膀胱灌注化疗
E. 经尿道膀胱肿瘤切除术

正确答案：E。经尿道膀胱肿瘤切除术

解析：不同临床分期膀胱癌的治疗现总结如下：Tis（原位癌）可行化疗药物或卡介苗（BCG）膀胱灌注治疗。Ta、T1期肿瘤行经尿道膀胱肿瘤电切术（TURBt），术后行膀胱灌注化疗。T2期低级别、局限的肿瘤可经尿道切除或行膀胱部分切除术。T3期低级别、单个局限、如病人不能耐受膀胱全切者可采用膀胱部分切除术；膀胱浸润性癌行根治性膀胱全切除术。T4期肌层浸润性癌常失去根治性手术机会，采用姑息性放化学治疗。故对于膀胱Ta期乳头状癌的治疗方法首选经尿道膀胱肿瘤切除术（E对）。